萜类在自然界分布广泛，种类繁多，不少萜类化合物对肝脏有明显毒副作用，可引起急性中毒性肝炎，出现转氨酶升高、黄疸、肝肿大。其中含萜类并具有肝脏毒性的中药是
A. 苍耳子
B. 黄药子
C. 蓖麻子
D. 相思子
E. 望江南子

正确答案：B。黄药子

解析：本题考查的是引起肝损伤的中药及其主要化学物质。含萜类并具有肝脏毒性的中药是黄药子（B对）。引起肝损伤的植物类中药及其主要化学物质：文献报道多、有明确肝损伤的中药有柴胡、川楝子、苍术、苍耳子、栀子、吴茱萸、艾叶、山豆根、番泻叶、何首乌、黄药子、雷公藤等。其肝毒性与所含成分有关。（1）生物碱类：为一类含氮有机化物，普遍存在于各科植物中，具有很强的生理活性，对机体具有毒副作用的生物碱大多数侵害中枢神经及自主神经系统，但也有一些生物碱具有典型的肝脏毒性，如含有吡咯双烷生物碱的中草药，包括菊科的千里光属（如千里光、菊三七等）、款冬属、蜂斗菜属、泽兰属，紫草科的紫草属、天芥菜属，可引起肝细胞坏死、肝纤维化，继而发展为肝硬化。（2）苷类：可分为强心苷类、氰苷类和皂苷类。强心苷类及氰苷类成分鲜有造成肝损伤的报道，皂苷有局部刺激作用，有的还有溶血作用。含皂苷的中药有三七、商陆、黄药子等，黄药子是目前公认的肝脏毒性中药。（3）毒蛋白类：毒蛋白主要存在于一些中药的种子中，如苍耳子（A错）、蓖麻子（C错）、望江南子（E错）、相思豆（D错）等，其中蓖麻毒蛋白的作用机制是阻断蛋白质的合成，和相思豆毒蛋白机制相似，相思豆蛋白的毒性反应是使肝脏坏死，淋巴充血。（4）多肽类：有一些毒性较大的活性肽，其中毒蕈植物中毒蕈伞对肝脏损害最重，其毒素为毒伞肽和毒肽，可损害细胞膜的功能，使肝细胞蛋白合成受到抑制引起肝脏损害。（5）萜与内酯类：萜类在自然界分布广泛，种类繁多，不少萜类化合物对肝脏有明显毒副作用，但肝损伤机制还不甚明了。包括有川楝子、黄药子、艾叶等，其中川楝子是含萜类肝脏毒性中药中最典型的一类药物，能引起急性中毒性肝炎，出现转氨酶升高、黄疸、肝肿大。（6）鞣质类：鞣质广泛存在于各种植物中，一般分为缩合鞣质和可水解鞣质。研究表明，缩合鞣质的毒性较低，对肝脏无毒或只有轻度损害，而可水解鞣质的毒性较高，是直接肝脏毒，长期大量应用可引起肝小叶中央坏死、脂肪肝、肝硬化。包括五倍子、石榴皮、诃子等，其中五倍子中含有大量可水解鞣质，进入机体后几乎全部被分解成倍酸与焦酸，极大量时可引起灶性肝细胞坏死。